小儿肾病综合征大量蛋白尿的定量标准是
A. ＞50mg/kg/24小时
B. ＞25mg/kg/24小时
C. ＞70mg/kg/24小时
D. ＞75mg/kg/24小时
E. ＞60mg/kg/24小时

正确答案：A。＞50mg/kg/24小时

解析：大量蛋白尿，尿蛋白（+++～++++），24小时尿蛋白定量≥50mg/kg；血浆白蛋白低于25g/L；血浆胆固醇高于5.7mmoL/L；不同程度的水肿。以上四项中以大量蛋白尿和低白蛋白血症为必要条件（A对，BCDE错）。